“纯阳学说”首见于
A. 《颅囟经》
B. 《幼科发挥》
C. 《幼幼集成》
D. 《小儿药证直诀》
E. 《温病条辨》

正确答案：A。《颅囟经》

解析：《颅囟经》中云“凡孩子3岁以下，呼为纯阳”，首次提出了小儿“纯阳”的学说（A对）。万全的《幼科发挥》对儿科的疾病有自己的见解（B错）。陈复正的《幼幼集成》对指纹诊法颇有见地，将虎口脉纹辨证概括为“浮沉分表里、红紫辨寒热、淡滞定虚实”，“风轻、气重、命危”（C错）。钱乙的《小儿药证直诀》将小儿的生理病理特点概括为“脏腑柔弱，易虚易实、易寒易热”（D错）。吴鞠通在《温病条辨》中运用阴阳理论，将小儿的生理特点概括为“稚阳未充，稚阴未长”（E错）。